女孩，3岁。出生时接种过卡介苗，2岁半时PPD试验硬结直径6mm，最近PPD硬结直径为18mm。其最可能是
A. 阴性反应
B. 曾经有结核感染
C. 新近有结核感染
D. 卡介苗接种后反应
E. 假阳性反应

正确答案：C。新近有结核感染

解析：结核菌素实验（PPD实验）属于迟发型变态反应，小儿感染结核4-8周即呈阳性反应。本例出生时接种卡介苗，2岁时PPD实验硬结直径6mm，最近硬结直径18mm，硬结直径突然增大至10mm以上，且增幅超过6mm，为新近有结核感染（C对）。阴性反应（A错）硬结直径小于5mm。曾经有结核感染（B错）（自然感染）硬结直径多为10-15mm。卡介苗接种后反应（D错）硬结直径5-9mm为阳性，表示接种有效。假阳性反应（E错）见于非结核分支杆菌感染。